治肺痈的药有
A. 红藤
B. 穿心莲
C. 败酱草
D. 鱼腥草
E. 紫花地丁

正确答案：B、C、D。穿心莲；败酱草；鱼腥草

解析：本题考查穿心莲、败酱草、鱼腥草的主治病证。治肺痈的药有穿心莲（B对）、败酱草（C对）、鱼腥草（D对）。穿心莲【主治病证】（1）温病初起，感冒发热，肺热咳喘，肺痈，咽喉肿痛。（2）痈疮疖肿，毒蛇咬伤。（3）湿热泻痢，热淋涩痛，湿疹。败酱草【主治病证】（1）肠痈，肝痈，肺痈，痈肿疮毒。（2）血滞之胸痛、腹痛，产后瘀阻腹痛。鱼腥草【主治病证】（1）肺痈咳吐脓血，肺热咳嗽痰稠。（2）热毒疮疡，湿热泻痢。（3）热淋涩痛。大血藤【来源】木通科植物大血藤的干燥藤茎。习称红藤（A错）。【主治病证】（1）肠痈腹痛，痈肿疮毒。（2）跌打损伤，痛经，闭经，产后瘀阻。（3）风湿痹痛。紫花地丁（E错）【主治病证】（1）疔疮肿毒，痈疽发背，丹毒，乳痈，肠痈。（2）目赤肿痛。（3）毒蛇咬伤。